可作为退热药的首选，尤其适合老年人和儿童服用的药品是
A. 阿司匹林
B. 布洛芬
C. 酮洛酸
D. 对乙酰氨基酚
E. 安乃近

正确答案：D。对乙酰氨基酚

解析：本题考查发热的药物治疗。可作为退热药的首选，尤其适合老年人和儿童服用的药品是对乙酰氨基酚（D对）。对乙酰氨基酚解热作用强，镇痛作用较弱，对胃肠道刺激小，正常剂量下对肝脏无损害。阿司匹林（A错）、酮洛酸（C错）对儿童副作用大，一般禁用于儿童。布洛芬（B错）镇痛作用较强，主要用于镇痛。20%安乃近（E错）溶液滴鼻可用于5岁以下儿童高热时紧急退热。